人耳能感觉到的声频范围是
A. ＜20Hz
B. 20～20000Hz
C. ＞20000Hz
D. 200～2000Hz
E. ＞2000Hz

正确答案：B。20～20000Hz

解析：本题考查人耳能感受到的声波范围。人耳能够感受到的声音频率在20～20OOOHz（B对ACDE错）之间，称为声波。频率小于20Hz的声波称为次声波，大于20OOOHz的声波称为超声波。人们语言交流的频率大多在500～2000Hz之间，称之为语言频率。